某男，56岁。1年前被确诊为肾结石、慢性肾炎、前列腺增生症。刻下血尿1天，伴腰腹疼痛、排尿不畅。经碎石治疗后，为巩固疗效，又请中医诊治，因工作繁忙无暇煎药，要求服用中成药，医师遂处以排石颗粒，以善其后。3个月后，患者又请中医诊治。诉云：连服排石颗粒月余，经复査肾结石已基本消除。问诊得知：近日尿中蛋白增加、少量血尿，并伴有神疲乏力、腰膝酸软、面目四肢浮肿、头晕耳鸣等症状。医师诊断为气阴两虚、脾肾不足、水湿内停所致的体虚浮肿，宜选用的中成药是
A. 萆薢分清丸
B. 茵陈五苓丸
C. 肾炎四味片
D. 肾炎康复片
E. 茵栀黄口服液

正确答案：D。肾炎康复片

解析：本题考查的是肾炎康复片的主治。近日尿中蛋白增加、少量血尿，并伴有神疲乏力、腰膝酸软、面目四肢浮肿、头晕耳鸣等症状。医师诊断为气阴两虚、脾肾不足、水湿内停所致的体虚浮肿，宜选用的中成药是肾炎康复片（D对）。肾炎康复片：【主治】气阴两虚，脾肾不足，水湿内停所致的体虚浮肿，症见神疲乏力、腰膝酸软、面目四肢浮肿、头晕耳鸣；慢性肾炎、蛋白尿、血尿见上述证候者。萆薢分清丸（A错）：【主治】肾不化气、清浊不分所致的白浊、小便频数。茵陈五苓丸（B错）：【主治】肝胆湿热、脾肺郁结所致的黄疸，症见身目发黄、脘腹胀满、小便不利。肾炎四味片（C错）：【主治】湿热内蕴兼气虚所致的水肿，症见浮肿、腰痛、乏力、小便不利；慢性肾炎见上述证候者。茵栀黄口服液（E错）：【主治】肝胆湿热所致的黄疸，症见面目悉黄、胸胁胀痛、恶心呕吐、小便黄赤；急、慢性肝炎见上述证候者。